以下哪一项不是职业病的特点
A. 病因明确
B. 有剂量-效应关系
C. 在同一工种人群中有一定的发病率
D. 康复效果较差

正确答案：D。康复效果较差

解析：本题考查职业病的特点。职业病具有下列五个特点：1.病因有特异性（A对）：只有在接触职业性有害因素后才可能患职业病；2.病因大多可以检测：通过对职业性有害因素的接触评估，由于职业因素明确，可通过检测评价工人的接触水平，而发生的健康损害一般与接触水平有关，并且在一定范围内能判定剂量-反应关系（B对）；3.不同接触人群的发病特征不同：由于接触情况和个体差异的不同，可造成不同接触人群的发病特征不同（C对）；4.早期诊断，合理处理，预后较好（D错，为本题正确答案）；5.大多数职业病，目前尚缺乏特效治疗，应加强保护人群健康的预防措施。